对交叉韧带损伤诊断有意义的是
A. 直腿抬高试验
B. 拾物试验
C. Mills征
D. Hoffmann征
E. 抽屉试验

正确答案：E。抽屉试验

解析：交叉韧带损伤时，可用抽屉试验（E对）辅助诊断，患者膝关节屈曲90°，检查者固定病人足部，用双手握住胫骨上段做拉前和推后动作，并注意胫骨结节前后移动的幅度。前移增加表示前交叉韧带断裂；后移增加表示后交叉韧带断裂。直腿抬高试验（P733）（A错）主要用于腰椎间盘突出时的体征检查。拾物试验（P754）（B错）主要用于腰椎结核时的体征检查。Mills征（P719）（C错）主要用于肱骨外上髁炎时的体征检查。Hoffmann征（P727）（D错）主要用于脊髓型颈椎病时的体征检查。